关于双胎错误的是
A. 胎盘一个或两个
B. 双胎性别一定一致
C. 双胎指纹可不同
D. 双胎外貌性格表型可不同
E. 羊膜腔可两个，也可一个

正确答案：B。双胎性别一定一致

解析：双卵双胎，胎盘多为两个，也可融合成一个，但血液循环各自独立（A对）。各自的遗传基因不完全相同，故形成的两个胎儿有区别，如血型、性别不同或相同，指纹（C对）、外貌、性格类型（D对）等多种表型不同（B错，为本题正确答案）。由于受精卵在早期发育阶段发生分裂的时间不同，形成下述4种类型：双绒毛膜双羊膜囊单卵双胎、单绒毛膜双羊膜囊单卵双胎、单绒毛膜单羊膜囊单卵双胎、联体双胎（E对）。